女性盆部淋巴主要分为
A. 腹股沟淋巴组与内生殖器淋巴组
B. 髂淋巴组与腹股沟淋巴组
C. 外生殖器淋巴组与内生殖器淋巴组
D. 盆腔淋巴组与内生殖器淋巴组
E. 盆腔淋巴组与外生殖器淋巴组

正确答案：E。盆腔淋巴组与外生殖器淋巴组

解析：女性生殖器官和盆腔具有丰富的淋巴系统，分为外生殖器淋巴与盆腔淋巴两组（E对）。